女，45岁，月经不规则2年余，阴道不规则流血20天，查体：中度贫血貌，子宫略大，稍软，无压痛，宫旁未触及异常。为确定诊断应首选的检查是
A. 液基细胞检查
B. 阴道镜检查
C. 尿hCG检查
D. 盆腔CT检查
E. 分段刮诊

正确答案：E。分段刮诊

解析：老年女性患者，月经不规则2年余，阴道不规则流血20天（约90%的子宫内膜癌患者出现阴道流血或阴道排液症状），子宫略大（晚期可有子宫明显增大），稍软，应高度怀疑子宫内膜癌，其确诊方法是分段诊刮（E对），其能刮取子宫内膜和内膜病灶行活组织检查，作出病理检查。液基细胞检查（P404）（A错）属于细胞学检查的一种，适用于恶性肿瘤的初步筛选，不作为诊断依据。阴道镜检查（P443）（B错）主要用于观察阴道和宫颈，对可疑部位行定位、活检，结合活检方可确诊。尿hCG检查（C错）即尿妊娠试验，临床用于诊断早孕，可用于辅助诊断宫外孕，估计先兆流产和预后，并可协助诊断并随访观察某些恶性肿瘤以及妇女受孕后，但不作为首选检查。盆腔CT检查（P439）（D错）能够显示肿瘤的结构特点、周围侵犯及远处转移的情况，多用于妇科肿瘤治疗方案的制定、预后估计、疗效观察及术后复发的诊断，不能作为确定诊断的首选检查。